完整叶片展平后呈椭圆状披针形或卵圆状披针形，先端钝，具有小芒尖，常反卷，两面无毛，叶脉于下表面突起的药材是
A. 侧柏叶
B. 大青叶
C. 艾叶
D. 罗布麻叶
E. 番泻叶

正确答案：D。罗布麻叶

解析：本题考查罗布麻叶的性状鉴别。罗布麻叶（D对）【性状鉴别】药材多皱缩卷曲，有的破碎，完整叶片展平后呈椭圆状披针形或卵圆状披针形，长2～5cm，宽0.5～2cm，淡绿色或灰绿色，先端钝，有小芒尖，基部钝圆或楔形，边缘具细齿，常反卷，两面无毛，叶脉于下表面突起；叶柄细，长约0.4cm。质脆。气微，味淡。侧柏叶（A错）【性状鉴别】药材本品多分枝，小枝扁平。叶细小鳞片状，交互对生，贴伏于枝上，深绿色或黄绿色。质脆，易折断。气清香，味苦涩、微辛。大青叶（B错）【性状鉴别】药材多皱缩卷曲，有的破碎。完整的叶片展平后呈长椭圆形至长圆状倒披针形，长5～20cm，宽2～6cm；上表面暗灰绿色，有的可见色较深稍突起的小点；先端钝，全缘或微波状，基部狭窄下延至叶柄呈翼状；叶柄长4～10cm，淡棕黄色。质脆。气微，味微酸、苦、涩。以叶片完整、色暗灰绿者为佳。艾叶（C错）【性状鉴别】药材多皱缩、破碎，有短柄。完整叶片展平后呈卵状椭圆形，羽状深裂，裂片椭圆状披针形，边缘有不规则的粗锯齿；上表面灰绿色或深黄绿色，有稀疏的柔毛和腺点；下表面密生灰白色绒毛。质柔软。气清香，味苦。番泻叶（E错）【性状鉴别】药材狭叶番泻：呈长卵形或卵状披针形，长1.5～5cm，宽0.4～2cm，叶端急尖，叶基稍不对称，全缘。上表面黄绿色，下表面浅黄绿色，无毛或近无毛，叶脉稍隆起。革质。气微弱而特异，味微苦，稍有黏性。尖叶番泻：呈披针形或长卵形，略卷曲，叶端短尖或微突，叶基不对称，两面均有细短毛茸。以叶片大、完整、色绿、梗少，无泥沙杂质者为佳。